男，53岁，身高1.72m，体重85kg。3个月前左脚第一趾跖关节夜间突然剧烈疼痛，患处关节局部红肿，对温度、触摸、震动极为敏感，1周左右自行缓解，但有反复发作。患者没有发热，使用抗生素治疗无效。近日有腰痛、血尿等症状出现，去医院就医。医师告知该病与饮食密切相关，对该患者蛋白质摄入正确的建议是
A. 吃动物的肝脏
B. 吃蛋和牛奶
C. 吃虾
D. 吃豆制品
E. 喝肉汤

正确答案：B。吃蛋和牛奶